用药前需要做皮试的药物包括
A. 细胞色素C注射液
B. 注射用青霉素钠
C. 破伤风抗毒素注射液
D. 肾上腺素注射液
E. 地塞米松注射液

正确答案：A、B、C。细胞色素C注射液；注射用青霉素钠；破伤风抗毒素注射液

解析：本题考查皮试。用药前需要做皮试的药物有β-内酰胺类的青霉素（注射青霉素钠（B对））、氨基糖苷类、碘对比剂、局麻药、生物制品（细胞色素C（A对）和破伤风抗毒素（C对）注射液）。